关于纤维性心包的描述，正确的是
A. 有脏层和壁层
B. 外面无附着物
C. 与膈的中心腱融合
D. 后方与第3胸椎为邻
E. 主要由迷走神经支配

正确答案：C。与膈的中心腱融合

解析：浆膜心包（A错）分脏、壁两层，位于心包囊的内层。纤维心包下方与膈的中心腱愈着（C对）。